什么是决定一个人适应环境的独特的行为模式和思维方式
A. 人格
B. 能力
C. 气质
D. 性格
E. 动机

正确答案：A。人格

解析：人格是决定一个人适应环境的独特的行为模式和思维方式，是个人比较稳定的心理特征的总和。掌握“人格”知识点。